按照有机化合物的分类，单糖是
A. 多元醇
B. 羧酸
C. 多羟基醛或酮
D. 酯
E. 醚

正确答案：C。多羟基醛或酮